下列关于宣威肺癌说法错误的是
A. 农民肺癌死亡率是全国最高地区之一
B. 女性肺癌死亡率居全国首位
C. 吸烟不是主要危险因素
D. 肺癌死亡率在两性间差别很大
E. 生活燃料与宣威肺癌死亡率间存在明显联系

正确答案：D。肺癌死亡率在两性间差别很大

解析：本题考查宣威肺癌的相关内容。肺癌死亡率在两性间差别不明显（D错，为本题正确答案）。宣威市是我国肺癌发病率最高的地区之一（A对），其肺癌死亡率也是高于全国平均水平的。女性肺癌死亡率居全国首位（B对）。吸烟不是宣威肺癌高发的主要危险因素（C对）。生活燃料与宣威肺癌死亡率间存在明显联系（E对），有研究结果表明室内燃煤空气污染是宣威肺癌高发的重要原因。